酸蚀指数为几度以上时可有敏感症状
A. 1
B. 2
C. 3
D. 4
E. 5

正确答案：B。2

解析：2度酸蚀症以上可出现牙本质过敏症，随着釉质和牙本质丧失量增加，相继出现牙髓疾病的症状。掌握“酸蚀症”知识点。